属于破伤风较为特异的临床表现是
A. 稽留热
B. 张口困难
C. 恐水
D. 昏迷
E. 坏疽

正确答案：B。张口困难

解析：破伤风梭菌可产生痉挛毒素，此毒素吸收至脊髓、脑干等处，与联络神经细胞的突触相结合，抑制突触释放抑制性递质。运动神经元因失去中枢抑制而兴奋性增强，致使随意肌紧张与痉挛。通常最先受影响的肌群是咬肌，相应出现的征象为张口困难（牙关紧闭）（B对）。稽留热（A错）常见于大叶性肺炎、斑疹伤寒及伤寒高热期。狂犬病以吞咽抽搐为主，喝水不能下咽，并留大量口涎，病人恐水（C错）。化脓性脑膜炎可有昏迷（D错）。气性坏疽（E错）是厌氧菌感染的一种，即梭状芽胞杆菌所致的肌坏死或肌炎。